支配咀嚼肌运动
A. 眼神经
B. 下颌神经
C. 面神经
D. 上颌神经
E. 舌下神经

正确答案：B。下颌神经

解析：眼神经（A错）分布于眶内、眼球、泪器、结膜、硬脑膜、部分鼻和鼻旁窦黏膜、额顶部及上脸和鼻背部的皮肤。下颌神经（B对）其运动纤维支配咀嚼肌、鼓膜张肌、腭帆张肌、下颌舌骨肌和二腹肌前腹。面神经（C错）主要支配面部表情肌。上颌神经（D错）分布于上颌牙、牙限、鼻腔黏膜、软腭黏膜及眼睑及睑裂与口裂之间的皮肤。舌下神经（E错）支配舌内肌和大部分舌外肌。